药品经营企业可以从事的采购活动是
A. 从非法药品市场采购
B. 采购医疗机构配制的制剂
C. 向无《药品经营许可证》的单位和个人采购
D. 向药品经营者采购超范围经营的药品
E. 从城乡集市贸易市场采购中药材

正确答案：E。从城乡集市贸易市场采购中药材

解析：本题考查中药材管理。药品经营企业可以从事的采购活动是从城乡集市贸易市场采购中药材（E对）。《药品管理法》及其实施条例规定，城乡集市贸易市场可以出售中药材。药品经营企业禁止非法采购药品（A错）。药品经营企业不得购进和销售医疗机构配制的制剂（B错）。药品生产、经营企业不能向无《药品经营许可证》的单位和个人采购药品（C错）。药品经营企业应按按照《药品经营许可证》许可的经营范围经营药品，在采购时，不得采购超范围经营的药品（D错）。